牙髓-牙本质复合体的增龄变化表现在以下几方面，除了
A. 髓腔由大变小
B. 细胞成分由多变少
C. 牙髓组织变性
D. 神经纤维，血管减少
E. 髓角不变

正确答案：E。髓角不变

解析：本题考查牙髓增龄性变化。牙髓-牙本质复合体的增龄变化除了髓角不变（E错，为本题的正确答案）。牙髓-牙本质复合体的增龄变化表现在体积、结构、功能三个方面。体积变化是由于继发性牙本质不断沉积造成的，表现为髓室由大变小（A对），髓角变低或消失。结构变化主要是细胞成分由多变少（B对），纤维成分相对增加，甚至发生牙髓组织变性（C对）；同时在衰老的牙髓中，神经纤维，血管减少（D对）。功能变化表现为牙髓的防御和修复能力降低。